东莨菪碱可用于
A. 眼内压下降
B. 休克
C. 重症肌无力患者肌张力增加
D. 流涎、震颤和肌肉强直症状的缓解
E. 肌肉松弛

正确答案：D。流涎、震颤和肌肉强直症状的缓解

解析：本题考查东莨菪碱。东莨菪碱为M受体阻断剂，有中枢抑制作用，能够抑制腺体分泌，可用于缓解流涎、震颤和肌肉强直症状（D对）；毛果芸香碱能够缩瞳、降低眼内压（A错）；新斯的明多用于重症肌无力及腹部手术后的肠麻痹，可使重症肌无力患者肌张力增加（C错）；休克（B错）是机体遭受强烈的致病因素侵袭后，由于有效循环血量锐减，机体失去代偿，组织缺血缺氧，神经体液因子失调的一种临床症候群；肌松药（E错）有N受体阻断剂如阿曲库铵、筒箭毒碱等。